不属于弥漫性结缔组织病的是
A. 系统性红斑狼疮
B. 硬皮病
C. 类风湿关节炎
D. 霍奇金病
E. 干燥综合征

正确答案：D。霍奇金病

解析：弥漫性结缔组织病有：类风湿关节炎（C对）、系统性红斑狼疮（A对）、硬皮病（B对）、多肌炎、重叠综合征、血管炎病、干燥综合征（E对）等。霍奇金病（D错，为本题正确答案）为淋巴瘤的一种特殊类型，不属于弥漫性结缔组织病。